某女，63岁。2天前，患视网膜静脉阻塞，症见视力下降，眼底瘀血征象，并见神疲乏力、咽干、口干。证属血瘀兼气阴两虚，宜选用的成药是
A. 黄连羊肝丸
B. 石斛夜光丸
C. 消栓通络胶囊
D. 血府逐瘀胶囊
E. 复方血栓通胶囊

正确答案：E。复方血栓通胶囊

解析：本题考查的是复方血栓通胶囊的主治。2天前，患视网膜静脉阻塞，症见视力下降，眼底瘀血征象，并见神疲乏力、咽干、口干。证属血瘀兼气阴两虚，宜选用的成药是复方血栓通胶囊（E对）。复方血栓通胶囊：【主治】血瘀兼气阴两虚证的视网膜静脉阻塞，症见视力下降或视觉异常、眼底瘀血征象、神疲乏力、咽干、口干等；以及血瘀兼气阴两虚的稳定型劳累性心绞痛，症见胸闷痛、心悸、心慌、气短、乏力、心烦、口干等。黄连羊肝丸（A错）：【主治】肝火旺盛所致的目赤肿痛，视物昏暗，羞明流泪，胬肉攀睛。石斛夜光丸（B错）：【主治】肝肾两亏、阴虚火旺所致的内障目暗，视物昏花。消栓通络胶囊（C错）：【主治】瘀血阻络所致的中风，症见神情呆滞、言语謇涩、手足发凉、肢体疼痛；缺血性中风及高脂血症见上述证候者。血府逐瘀胶囊（D错）：【主治】气滞血瘀所致的胸痹、头痛日久、痛如针刺而有定处、内热烦闷、心悸失眠、急躁易怒。